诱发动物全身性Shwartzman反应时，第一次注入小剂量内毒索的作用是．
A. 使动物体内凝血系统激活
B. 使血管内皮系统广泛受损
C. 封闭单核-巨噬细胞系统
D. 消耗体凝血抑制物
E. 消耗体内大量纤溶酶

正确答案：C。封闭单核-巨噬细胞系统

解析：诱发动物全身性Shwartzman反应时，第一次注入小剂量内毒索的作用是封闭单核-巨噬细胞系统（C对ABDE错），第二次注入内毒素时易引起DIC。